大鼠出生后饲以去脂饮食，结果将引起下列哪种脂质缺乏
A. 磷脂酰胆碱
B. 甘油三酯
C. 鞘磷脂
D. 胆固醇
E. 前列腺素

正确答案：E。前列腺素

解析：人体营养必需脂肪酸有亚油酸、ɑ-亚麻酸（B对）和花生四烯酸，人体不能自身合成，只能从食物中补充。前列腺素（E对）、血栓噁烷、白三烯是人体必需脂肪酸的衍生物，因此去脂膳食的大鼠可以引起这些物质缺乏。磷脂酰胆碱（A错）、甘油三酯（B错）、鞘磷脂（C错）、胆固醇（D错）均可在体内合成。